自我药疗时，解热镇痛药用于镇痛，连续用药时间不宜超过
A. 1日
B. 3日
C. 5日
D. 7日
E. 10日

正确答案：C。5日

解析：本题考查解热镇痛药的使用。解热镇痛药用于疼痛时一般不超过5天（C对），如症状未缓解，可能是用药不对症或者病症比较严重，应去医院就诊，对症治疗；用于解热时一般不超过3天（B错），如长期反复发热，可能是用药不对症或者病症比较严重，应及时去医院就诊，对症治疗。